为了解某地区铅污染的情况，抽样收集了130人的尿铅值，经分析发现数据为偏态分布。若要对数据进行描述，应选择集中趋势和离散程度的指标为
A. 中位数和标准差
B. 中位数和极差
C. 中位数和四分位间距
D. 算术均数和标准差
E. 算术均数和四分位间距

正确答案：C。中位数和四分位间距

解析：偏态分布的数据资料：集中趋势用中位数来描述；离散程度用四分位间距描述（C对）。正态分布的数据资料：集中趋势用均数描述；离散程度用标准差描述（ADE错）。四分位数间距与极差（B错）相比不易受极端值的影响，因此偏态分布的数据资料用四分位间距描述其离散程度。